WHO提出的EPI指的是
A. 初级卫生保健
B. 人人享有卫生保健
C. 扩大免疫规划
D. 全程免疫规划

正确答案：C。扩大免疫规划

解析：本题考查EPI。WHO提出的EPI指的是扩大免疫规划（C对ABD错），它要求各成员国发展和坚持免疫方法和流行病学监测相结合，防制白喉、百日咳、破伤风、麻疹、脊髓灰质炎、结核病等传染病，重点是提高免疫接种覆盖率（使每个儿童在出生后都有获得免疫接种的机会）和不断扩大免疫接种疫苗种类。